具有镇静、止痛、缓解肌肉痉挛选用的电针波型是
A. 疏波
B. 密波
C. 疏密波
D. 断续波
E. 锯齿波

正确答案：B。密波

解析：密波（频率快的连续波）易产生抑制效应，具有镇静、止痛、缓解肌肉和血管痉挛的作用（B对）；疏波（频率慢的连续波）兴奋作用较为明显，常用于治疗痿证、慢性疼痛和各种肌肉、关节、韧带、肌腱的损伤等（A错）。疎密波能增加代谢，促进气血循环，改善组织营养，消除炎性水肿（C错）。断续波对横纹肌有良好的刺激收缩作用，常用于治疗痿证、瘫痪等（D错）。